牙组织不包括
A. 牙质
B. 釉质
C. 牙髓
D. 牙骨质
E. 牙周膜

正确答案：E。牙周膜

解析：牙组织包括牙质(A对)，釉质(B对)，牙髓(C对)及牙骨质(D对)，牙周膜属于牙周组织(E错，为本题正确答案)。